患者的言谈缺乏主题，很难让人理解他的用意，以下临床表现属于什么症状
A. 思维奔逸
B. 思维散漫
C. 思维贫乏
D. 思维中断
E. 思维迟缓

正确答案：B。思维散漫

解析：该患者的言谈缺乏主题，以至于别人弄不懂所要阐述的主题思想是什么为思维散漫（B对）。思维奔逸的患者感到脑子特别灵活，就像机器加了“润滑油”（A错）。思维贫乏的患者感到脑子空空荡荡，没什么思想（C错）。思维中断表现为患者在无意识障碍，又无外界干扰时，言语突然停顿，片刻之后又重新开始，但所谈主题已经转换（D错）。思维迟缓的患者则感到脑子就像生了锈的机器，变笨了反应变慢了（E错）。